由三个胚层的各种成熟组织构成为
A. 无性细胞瘤
B. 颗粒细胞瘤
C. 畸胎瘤
D. 绒毛膜癌
E. 内胚窦瘤

正确答案：C。畸胎瘤

解析：成熟畸胎瘤（C对）是最常见的生殖细胞肿瘤，镜下可见肿瘤由三个胚层的各种成熟组织构成。无性细胞瘤（P298）（A错）由未分化、多潜能原始生殖细胞构成。颗粒细胞瘤（P296）（B错）由颗粒细胞（女性的性索间质细胞瘤）构成。绒毛膜癌（P293）（D错）由分化不良的似细胞滋养层和似合体细胞滋养层两种瘤细胞构成。内胚窦瘤（P299）（E错）由胚外组织构成。